全凭静脉麻醉是指
A. 单独使用一种静脉麻醉药物
B. 单独使用一、两种静脉麻醉药物
C. 单独使用静脉麻醉药物
D. 单独使用全麻辅助药物
E. 静脉麻醉药与全麻辅助药物联合使用

正确答案：E。静脉麻醉药与全麻辅助药物联合使用

解析：由于单独使用一两种静脉麻醉药物常镇痛不全，不良反应多，故通常将几种静脉麻醉药物和全麻辅助药物完全经静脉联合使用，称为全凭静脉麻醉。掌握“全身麻醉”知识点。